下列何结构属一般内脏运动核
A. 迷走神经背核
B. 副神经核
C. 黑质
D. 面神经核
E. 脊髓骶2-4节段的中间外侧核

正确答案：A。迷走神经背核

解析：一般内脏运动核包括动眼神经副核、上泌涎核、下泌涎核和迷走神经背核（A对）；特殊内脏运动核包括三叉神经运动核、面神经核（D错）、疑核和副神经核（B错）；黑质（C错）为锥体外系路径上的结构；脊髓骶2-4节段的中间外侧核（E错）属于内脏下行通路。